指出药物的物理常数缩写：[α]tD
A. 百分吸收系数
B. 比旋度
C. 折光率
D. 熔点
E. 沸点

正确答案：B。比旋度

解析：本题考查比旋度。比旋度（B对）是指偏振光透过长1dm，且每1ml中含有旋光性物质1g的溶液，在一定波长与温度下，测得的旋光度称为比旋度，以[α]tD表示。百分吸收系数（A错）以E1%1cm表示；折光率（C错）以ntD表示；熔点（D错）以m.p表示；沸点（E错）以b.p表示。